下列哪一项不是脾的主要生理功能
A. 主统血
B. 主藏血
C. 主升清
D. 主运化水谷
E. 主运化水液

正确答案：B。主藏血

解析：肝的生理功能有主藏血（B错，为本题正确答案）。脾的生理功能：1.运化谷食（D对）；2.运化水饮（E对）；3.主统血（B对）；生理特性有主升清（C对）。